根据苷原子分类，属于C-苷的是
A. 山慈菇苷
B. 黑芥子苷
C. 巴豆苷
D. 芦荟苷
E. 毛茛苷

正确答案：D。芦荟苷

解析：本题考查的是苷类化合物按苷键原子的分类。根据苷原子分类，属于C-苷的是芦荟苷（D对）。依据苷键原子的不同可将苷分为O-苷、S-苷、N-苷和C-苷。1.氧苷（O-苷）：以苷元不同，又可分为醇苷、酚苷、氰苷、酯苷和吲哚苷。（1）醇苷：如红景天苷、毛茛苷（E错）、獐牙菜苷。（2）酚苷：如天麻苷、水杨苷。（3）氰苷：如苦杏仁苷。（4）酯苷：如山慈菇苷（A错）A等。（5）吲哚苷：如靛苷。2.硫苷（S-苷）：如萝卜苷、芥子苷（B错）。3.氮苷（N-苷）：如核苷类物质腺苷、鸟苷、胞苷和尿苷，中药巴豆中的巴豆苷（C错）。4.碳苷（C-苷）：如牡荆素、芦荟苷。